根据阴阳理论，下列属阳的是
A. 滋润
B. 兴奋
C. 抑制
D. 凝聚
E. 收敛

正确答案：B。兴奋

解析：本题考查的是阴阳的属性。根据阴阳理论，下列属阳的是兴奋（B对）。阴阳，是对自然界相互关联的某些事物和现象对立双方属性的概括，即含有对立统一的概念。阴和阳的相对属性引入于医学领域，即把对于人体具有推动、温煦、兴奋等作用的物质和功能，统属于阳；对于人体具有凝聚（D错）、滋润（A错）、抑制（C错）等作用的物质和功能，统属于阴。收敛（E错）性属沉降，属阴。药物的升降沉浮：升是上升，降是下降，浮为浮散，沉为重镇等作用。大抵具有升阳、发表、祛风、散寒、涌吐、开窍等功效的药物，多上行向外，其性升浮，升浮者为阳；具有泻下、清热、利尿、重镇安神、潜阳息风、消导积滞、降逆、收敛等功效的药物，多下行向内，其性皆沉降，沉降者为阴。